下列哪项职业性多发病的说法不正确
A. 又称工作有关疾病
B. 是多因素疾病
C. 职业因素是原因之一
D. 职业因素可使潜在疾病暴露或使已有疾病加重
E. 在一般人群中不会出现

正确答案：E。在一般人群中不会出现